对合并糖尿病及肾病的高血压患者的降压目标是
A. ＜130/80mmHg
B. ＜140/85mmHg
C. ＜150/90mmHg
D. ＜160/95mmHg
E. ＜170/100mmHg

正确答案：A。＜130/80mmHg

解析：本题考查高血压的治疗。高血压可以合并脑血管病、冠心病、心力衰竭、慢性肾功能不全和糖尿病等多种疾病。其中，慢性肾功能不全合并高血压者，降压治疗的目的主要是延缓肾功能恶化，预防心、脑血管病发生。2型糖尿病往往较早就与高血压并存，往往同时还伴有肥胖和血脂代谢紊乱，属于心血管疾病高危群体。因此应该积极降压治疗，ACEI或ARB能有效减轻和延缓糖尿病肾病的进展，可作为首选，降压目标为＜130/80mmHg（A对）。